最早应用于临床的抗结核药是
A. 西索米星
B. 新霉素
C. 链霉素
D. 奈替米星
E. 阿米卡星

正确答案：C。链霉素

解析：本题考查抗结核药。链霉素（C对）是用于临床的第一个氨基糖苷类抗生素，也是第一个用于治疗结核病有效而且至今仍作为抗结核病的一线药物。